女性，45岁。肥胖多年，口渴5个月，尿糖（+），空腹血糖7.9mmol/L，饭后2小时血糖12.1mmol/L。下列哪一组生化指标，达到糖尿病临时满意控制：空腹血糖（mmol/L），饭后2小时血糖（mmol/l）
A. ＜5.6，＜7.2
B. ＜6.1，＜7.8
C. ＜7.1，＜8.3
D. ＜7.8，＜8.3
E. ＜8.3，＜10.0

正确答案：B。＜6.1，＜7.8

解析：中年女性患者（2型糖尿病常见人群），肥胖多年（2型糖尿病易感因素），口渴5个月（常见症状），尿糖（+），空腹血糖7.9mmol/L，饭后2小时血糖12.1mmol/L，符合糖尿病诊断标准，因此本例患者最可能的诊断为2型糖尿病。达到糖尿病临时满意控制状态：空腹血糖＜6.1mmol/L， 饭后2小时血糖＜7.8mmol/L（B对）。